女，25岁，痛经加重半年，双合诊见阴道后穹窿蓝紫色结节，双附件未扪及肿大，判断是哪种疾病
A. 子宫内膜异位症
B. 子宫腺肌病
C. 盆腔炎后遗症
D. 卵巢癌转移
E. 子宫内膜癌

正确答案：A。子宫内膜异位症

解析：生育期女性有继发性痛经且进行性加重、不孕或慢性盆腔痛，妇科检查扪及与子宫相连的囊性包块或盆腔内有触痛性结节，即可初步诊断为子宫内膜异位症（A对）；子宫腺肌病可依据典型的进行性痛经和月经过多史，妇科检查子宫均匀增大或局限性隆起，质硬且有压痛而作出初步诊断。影像学检查有一定帮助，可酌情选择，确诊取决于术后的病理学检查（B错）；盆腔炎性疾病后遗症：不孕、异位妊娠、慢性盆腔痛、盆腔炎性疾病反复发作（C错）；绝经后及绝经过渡期异常子宫出血为子宫内膜癌最常见的症状（E错）。